具有碳青霉烯结构的非典型β-内酰胺抗生素是
A. 舒巴坦钠
B. 克拉维酸
C. 亚胺培南
D. 氨曲南
E. 克拉霉素

正确答案：C。亚胺培南

解析：本题考查碳青霉烯类抗菌药。亚胺培南（C对）是具有碳青霉烯结构的非典型β-内酰胺抗生素，对大多数β-内酰胺酶高度稳定，对脆弱杆菌、铜绿假单胞菌有高效。舒巴坦钠（A错）、克拉维酸（B错）、氨曲南（D错）均为β-内酰胺酶抑制剂。克拉霉素（E错）属于大环内酯类抗菌药物。